女，40岁。畏寒、高热伴腰痛，尿频、尿急。尿痛2天。查体：左侧肾区有压痛和叩击痛，尿WBC40～50/HP，白细胞管型5/LP。血WBC15.4×10⁹/L，N0.87。最可能的诊断是
A. 急性膀胱炎
B. 尿路结石
C. 急性肾盂肾炎
D. 急性肾小球肾炎
E. 尿路综合症

正确答案：C。急性肾盂肾炎

解析：40岁中年女性患者（为易感人群），畏寒、高热伴腰痛（全身症状明显，上尿路感染征象），尿频、尿急、尿痛2天（尿路刺激征）。查体：左侧肾区有压痛和叩击痛，尿WBC40～50/HP（正常尿WBC＜5/HP），白细胞管型5/LP。血WBC15.4×10⁹/L（正常值为4～10×10⁹/L），0.87（正常值为0.5～0.7），提示患者有细菌感染。患者发病较急，有尿路刺激征，全身症状较明显，综合症状、体征及辅助检查结果，考虑诊断急性肾盂肾炎（C对）。急性膀胱炎（A错）为下尿路感染，一般无全身感染症状，主要表现为膀胱刺激征。尿路结石（B错）一般有明显的尿路绞痛症状。急性肾小球肾炎（D错）临床表现为血尿、蛋白尿、水肿、高血压，可伴有一过性肾功能不全。患者尿常规提示白细胞尿，考虑有细菌感染，故排除尿路综合征（E错）。